消除粉尘危害的主要途径是
A. 改革工艺、革新设备
B. 湿式作业
C. 密闭、抽风、除尘
D. 加强个人防护

正确答案：A。改革工艺、革新设备

解析：本题考查控制粉尘的措施。简称为八字方针，革、水、密、风、护、管、教、查。1.革，要求改革生产工艺和革新生产设备（A对BCD错），是消除粉尘危害的根本途径；2.水，即湿式作业，增大空气湿度，可降低环境粉尘浓度；3.密，密闭尘源；4.风，加强通风及抽风除尘；5.护，做好个人防护；6.管，经常性地维修和管理工作；7.教，加强宣传教育；8.查，定期检查环境空气中粉尘浓度，保证接触者的定期体格检查。